缺血－再灌注损伤是指：
A. 缺血后引起的损伤
B. 再灌注时引起的损伤
C. 缺血后恢复血流引起的后果
D. 缺血后恢复血流损伤反而加重
E. 以上都不是

正确答案：D。缺血后恢复血流损伤反而加重

解析：缺血－再灌注损伤是指缺血后恢复血流损伤反而加重（D对）。